临床上常用静脉输入葡萄糖酸钙抢救高镁血症，其主要机制为
A. 钙能拮抗镁对神经肌肉的抑制作用
B. 钙能减少镁在肠道的吸收
C. 钙能促进镁的排出
D. 钙能使静息电位负值变小
E. 钙能促进镁进入细胞内

正确答案：D。钙能使静息电位负值变小

解析：Ca2+能促使Et上移（D对），使Em-Et间距离增加甚至恢复正常，恢复心肌的兴奋性。另一方面钙和镁在肾小管中重吸收时有相互竞争作用，可使肾排镁增多。